长期饮用劣质白酒可引起视力减退甚至失明，其原因与酒中下列哪种有害物质含量较高有关
A. 甲醇
B. 杂醇油
C. 醛类
D. 氢氰酸
E. 铅

正确答案：A。甲醇